混淆因素的作用是
A. 使暴露因素与研究结果之间的关联减弱
B. 使暴露因素与研究结果之间的关联增强
C. 使暴露因素与研究结果之间的关联增强或减弱
D. 使暴露因素与研究结果之间的关联无关
E. 以上均不对

正确答案：C。使暴露因素与研究结果之间的关联增强或减弱